三七的须根习称
A. 三七
B. 剪口
C. 筋条
D. 芋
E. 绒根

正确答案：E。绒根